本能冲动和被压抑愿望属于
A. 意识冲突
B. 潜意识冲突
C. 前意识冲突
D. 下意识冲突
E. 意识控制

正确答案：B。潜意识冲突

解析：潜意识是指人的心理结构的深层，那些我们意识不到的，但却激发我们大多数的言语、情感和行为的原始冲动或本能欲望。潜意识的内容包括本能的能量和被压抑的欲望（B对）。精神分析理论认为潜意识里的神经症性冲突是导致神经症性心理障碍的重要原因。潜意识冲突，主要指童年时形成以及没有得到解决的冲突，多数一般或重大的冲突都涉及俄狄浦斯期（4~6岁）。最典型的潜意识冲突存在于力比多或攻击的愿望与惧怕失落、惧怕报复及现实世界的限制之间，或者说冲突存在于愿望满足与不能满足之间。在这里，人的力比多愿望应理解为渴望趋近或得到某种客体（如喜爱的人或物）的愿望。攻击的愿望是一种破坏性的愿望，即避开或破坏某种客体的愿望。